下列都是植物所产生的有毒物质，除外
A. 透明质酸酶
B. 糖苷
C. 霉菌毒素
D. 生物碱
E. 毒蛋白

正确答案：A。透明质酸酶

解析：本题考查植物毒素的相关内容。植物毒素指一类天然产生的（如由植物、微生物或是通过自然发生的化学反应而产生的）物质，通常对植物生长有抑制作用或对植物有毒，并且往往对人、动物也有毒害作用。植物毒素主要有生物碱（D对）、糖苷（B对）、毒蛋白（E对）、多肽、胺类、草酸盐和霉菌毒素（C对）等。透明质酸酶（A错，为本题正确答案）不是植物毒素。